硝酸甘油舒张血管平滑肌的作用机制是
A. 对血管的直接舒张作用
B. 产生一氧化氮（NO），使细胞内环磷酸鸟苷（cGMP）升高
C. 阻断α肾上腺素受体
D. 阻断β肾上腺素受体
E. 阻滞钙离子通道

正确答案：B。产生一氧化氮（NO），使细胞内环磷酸鸟苷（cGMP）升高

解析：本题考查硝酸甘油。硝酸甘油进入平滑肌细胞可分解为NO，增加cGMP的生成，使钙离子从细胞释放而松弛平滑肌。硝酸甘油不能直接作用于血管使血管舒张（A错），对α肾上腺素受体无作用（C错），对β肾上腺素受体无作用（D错），对钙离子通道无作用（E错）。